男婴，6个月。出生时诊断为“法洛四联症”。近2天常于哭闹时突然四肢抽搐，青紫加重，神志不清，呼吸急促，持续时间约2～3分钟。首先应考虑为
A. 脑栓塞
B. 休克
C. 脑脓肿
D. 缺氧发作
E. 心力衰竭

正确答案：D。缺氧发作

解析：已诊断为法洛四联症的患儿，近日出现哭闹、四肢抽搐、青紫加重，神志不清呼吸急促的临床症状，应诊断为缺氧发作（D对）。脑栓塞一般发生在有动脉粥样硬化的老年人，很少发生在小儿（A错）。该患儿并没有循环血量减少得病史，故不能诊断为休克（B错）。脑脓肿患儿会有头痛、呕吐等临床表现，与该患儿的表现不符（C错）。该患儿只有缺氧相关的临床表现，心力衰竭者不会仅仅有缺氧的症状，还有其他系统的症状（E错）。